男，40岁，车祸后出现短暂昏迷，2小时后剧烈头痛，频繁呕吐。急诊查体：神志清楚，双侧瞳孔大小多变，对光反射迟钝，肢体活动正常。行头颅CT检查途中，发生呼吸骤停，最可能的原因是
A. 脑挫裂伤
B. 急性颅后窝血肿并发枕骨大孔疝
C. 急性颅内血肿并发小脑幕切迹疝
D. 脑干损伤
E. 脑震荡

正确答案：B。急性颅后窝血肿并发枕骨大孔疝

解析：青年男性患者，车祸后出现短暂昏迷，剧烈头痛、频繁呕吐（颅内高压的表现），查体发现双侧瞳孔大小多变，对光反射迟钝，之后突然发生呼吸骤停（枕骨大孔疝的表现）。结合患者病史、症状和体查，最可能的诊断是急性颅后窝血肿并发枕骨大孔疝（B对）。脑挫裂伤（P188）（A错）也可出现头痛、呕吐及意识障碍等表现，但一般不会出现瞳孔改变和突发的呼吸骤停。急性颅内血肿并发小脑幕切迹疝（P183）（C错）可出现头痛、呕吐等颅内高压的表现，早期瞳孔可出现一过性缩小，之后逐渐散大，与患者临床表现不符。脑干损伤（D错）较少见，主要表现为伤后立即出现昏迷，各种反射消失，去皮质强直和肢体瘫痪、肌张力增高腱反射亢进等锥体束征表现突出，呼吸功能紊乱在伤后立即出现。脑震荡（P188）（E错）是最轻的脑损伤，典型表现为伤后即刻发生短暂的意识障碍和近事遗忘，与患者临床表现不符。